母乳中含量很低的营养索是
A. 钙和维生素D
B. 钙和维生素A
C. 铁和维生素A
D. 铁和维生素D
E. 维生素A和维生素D

正确答案：D。铁和维生素D